盖林（Guerin）是
A. 德国人
B. 英国人
C. 美国人
D. 法国人
E. 瑞典人

正确答案：D。法国人

解析：本题考查盖林（Guerin）的国籍。盖林（Guerin）是法国人（D对ABCE错），其1848年第一次提出社会医学概念。